女童开始明确地辨认同性和异性的时期是
A. 婴儿期
B. 幼儿期
C. 学龄前期
D. 青春前期
E. 青春期

正确答案：C。学龄前期

解析：本题考查女童期的心理特点。学龄前期（C对ABDE错）女童开始明确地辨认性别，知道男女性别角色的异同”。